男，12岁。发热2天，伴头痛、神志不清1天，8月中旬来诊。查体：T39.5℃，神志不清，克氏征布氏征（+）。实验室检查：血WBC16×10⁹/L。为确诊应进行的检查是
A. 钩体显凝试验
B. 血涂片找疟原虫
C. 血培养
D. 脑脊液常规及培养
E. 血清特异性IgM抗体

正确答案：E。血清特异性IgM抗体

解析：12岁男性患儿，8月中旬来诊（乙脑流行季节）；发热2天，伴头痛、神志不清1天，查体：提问39.5℃（高热），神志不清（出现中枢神经系统症状），克氏征、布氏征（+）（病理征阳性）；实验室检查：血WBC16×10⁹/L（白细胞总数增高），根据患儿的临床表现和实验室检查，最可能的诊断为流行性乙型脑炎。流行性乙型脑炎的病原体是流行性乙型脑炎病毒，传播媒介为蚊，好发于夏秋季。为确诊应进行的检查是血清特异性IgM抗体（E对），可用荧光免疫或ELISA技术检测发病初期患者血液或脑脊液中的乙脑病毒抗原，ELISA法检测患者血清中或脑脊液中的特异性IgM抗体，阳性率可达90%以上，阳性结果对早期诊断有重要意义。钩体显凝试验（A错）用于对钩端螺旋体病的检测（八版传染病学P256）。血涂片找疟原虫（B错）是疟疾的确诊方法（八版传染病学P284）。血培养（C错）一般用于细菌学检测，而不用于病毒检测。脑脊液常规及培养（D错）无特异性。